椎管内蛛网膜下隙的末端位于
A. 第1腰椎
B. 第2腰椎
C. 第2骶椎
D. 第4骶椎
E. 第3腰椎

正确答案：C。第2骶椎

解析：终池为椎管内蛛网膜下隙的末端，位于第2骶椎（C对）临床上常在第3、4或第4、5腰椎间行腰椎穿刺，以抽取脑脊液或注入药物（临床上的腰麻），以免损伤脊髓。